具有调理作用的补体成分是
A. C3a
B. C3b
C. C4a
D. C5a
E. C6a

正确答案：B。C3b